龋病流行程度评价指标属于中等是
A. 0.0-1.1
B. 1.2-2.6
C. 2.7-4.4
D. 4.5-6.5
E. 6.6以上

正确答案：C。2.7-4.4

解析：本题考查龋病流行程度评价标准。龋病流行程度评价指标属于中等是2.7-4.4（C对）。0.0-1.1（A错）很低；1.2-2.6（B错）低；4.5-6.5（D错）高；6.6以上（E错）很高。